最终导致肾小球损伤并产生相应的临床症状主要是
A. 循环免疫复合物沉积及原位免疫复合物形成
B. 细胞免疫
C. 免疫反应激活炎性细胞使之释放炎性介质致肾损害
D. 凝血剂纤溶系统因子，细胞粘附分子
E. 肾小球固有细胞在特定条件下有致损伤作用

正确答案：C。免疫反应激活炎性细胞使之释放炎性介质致肾损害

解析：多数肾小球疾病是免疫介导性炎症疾病。一般认为，免疫机制是肾小球疾病的始发机制，在此基础上，免疫反应激活炎性细胞使之释放炎性介质致肾损害（C对），最终导致肾小球损伤并产生相应的临床症状。其中免疫反应包括体液免疫和细胞免疫（B错），循环免疫复合物沉积及原位免疫复合物形成（A错）为体液免疫的重要组成部分，必须引起炎症反应才能导致肾小球损伤及其临床症状。凝血及纤溶系统因子，细胞粘附分子（D错）等主要与机体凝血过程有关。肾小球固有细胞指肾小球毛细血管内皮细胞、肾小球毛细血管上皮细胞以及肾小球系膜细胞，共同构成滤过屏障，具有支持和保护的作用。在免疫反应或炎症反应后可以引起肾小球固有细胞增生、肿胀、变形等，导致肾功能损伤。但是，肾小球固有细胞在特定条件下有致损伤作用（E错）不是最终导致肾小球损伤并产生相应的临床症状的主要原因。